消化道平滑肌细胞的静息电位大概为
A. -60～-40mV
B. -60～-50mV
C. -60～-55mV
D. -50～-40mV
E. -60～-55mV

正确答案：B。-60～-50mV